利尿作用最强、起效最快的药物是
A. 甘油果糖
B. 螺内酯
C. 乙酰唑胺
D. 氢氯噻嗪
E. 呋塞米

正确答案：E。呋塞米

解析：本题考查呋塞米。利尿作用最强、起效最快的药物是呋塞米（E对）。呋塞米作用于髓袢升支粗段的Na⁺-K⁺-2Cl⁻同向协转运系统，影响肾的稀释与浓缩功能，发挥利尿作用，减少氯化钠和水的重吸收，是临床常用高效利尿药。甘油果糖（A错）是渗透性利尿药（脱水药），用于脑血管病、脑外伤、脑肿癌、颅内炎症及其它原因引起的急慢性颅内压增高，脑水肿等症。螺内酯（B错）是醛固酮受体拮抗剂，作用于远曲小管远端和集合管，阻滞Na⁺通道从而产生排钠利尿的作用，属于低效利尿药。乙酰唑胺（C错）为碳酸酐酶抑制剂。通过抑制远曲小管和近曲小管的碳酸酐酶，降低细胞内氢离子的产生，使H⁺-Na⁺交换减少，增加水和碳酸盐的排出而产生利尿作用。氢氯噻嗪（D错）作用于远曲小管近端，抑制Na⁺-Cl⁻协转运体，使NaCl重吸收减少，发挥利尿作用，为中效利尿药，是常用的降压药，与ACEI联用，在协同降压的同时，兼具防治高钾血症。